前面有肠系膜上动脉跨过的是
A. 十二指肠球部
B. 十二指肠纵襞
C. 十二指肠水平部
D. 十二指肠升部
E. 十二指肠悬韧带

正确答案：C。十二指肠水平部

解析：十二指肠水平部(C对)前面有肠系膜上动脉紧贴于此部下行。